对注销注册有异议的执业医师，申请复议的期限为自收到注销注册通知之日起
A. 6个月内
B. 3个月内
C. 1个月内
D. 15日内
E. 7曰内

正确答案：D。15日内

解析：被注销注册的当事人有异议的，可以自收到注销注册通知之日起在15日内（D对），依法申请复议或者向人民法院提起诉讼。